女，25，右乳房肿块三月余，右乳外上象限触及3cm结节，无压痛，淋巴结无肿大。超声检查，低回声结节边界清楚内部钙化灶，该患者的诊断。
A. 乳房内瘤
B. 乳管内乳头状瘤
C. 乳腺囊性増生
D. 乳腺癌
E. 乳房纤维腺瘤

正确答案：E。乳房纤维腺瘤

解析：青年女性患者，右乳房肿块三月余，右乳外上象限触及3cm结节，无压痛，淋巴结无肿大（乳房纤维腺瘤表现）。超声检查，低回声结节边界清楚内部界钙化灶（符合乳房纤维腺瘤征象），故该患者的诊断考虑为乳房纤维腺瘤（E对）。乳房肉瘤临床上常见于50岁以上的妇女，表现为乳房肿块，体积可较大，但有明显边界，活动度较好，皮肤表面可见扩张静脉（A错）。乳管内乳头状瘤多见于经产妇，40-50岁为多，临床特点一般无自觉症状，常因乳头溢液污染内衣而引起注意，溢液可为血性、暗棕色或黄色液体（B错）。乳腺囊性増生有乳房胀痛，一般于月经前明显，月经后减轻，严重者整个月经周期都有疼痛（C错）。乳腺癌早期表现是病侧乳房出现无痛、单发的小肿块，常是病入无意中发现。肿块质硬，表面不光滑，与周围组织分界不很清楚，在乳房内不易被推动（D错）。